有明显的肝肠循环特点，维持时间较长的抗生素是
A. 环丙沙星
B. 利福平
C. 多西环素
D. 磺胺嘧啶
E. 庆大霉素

正确答案：C。多西环素